女，65岁。常规体检发现脾左肋下5cm，化验：Hb135g/L，WBC117×10⁹/L分类中幼粒5%，晚幼粒12%，杆状核22%，分叶中性粒34%，嗜酸粒5%，嗜碱粒14%，淋巴细胞14%。Plt560×10⁹/L，NAP（-）。最有效的治疗是
A. 羟基脲
B. 脾切除
C. 阿糖胞苷
D. 糖皮质激素
E. 伊马替尼

正确答案：E。伊马替尼

解析：患者诊断为慢性粒细胞白血病，首选分子靶向药物酪氨酸激酶抑制剂（TKI）伊马替尼（E对）治疗，可获得较高的完全细胞遗传学缓解率。羟基脲（P574）（A错）目前用于高龄、具有并发症、TKI和IFN-α均不耐受的患者以及用于高白细胞淤滞时的降白细胞处理；脾切除（B错）用于脾亢、遗传性球形细胞增多症等的治疗；阿糖胞苷（P576）（C错）主要用于急性髓系白血病的治疗；糖皮质激素（P582）（D错）可用于慢性淋巴细胞白血病的治疗。